可以用来确定健康中小学生体育课基本部分是否适宜的指标是
A. 心率
B. 最大心率
C. 靶心率
D. 10秒心率
E. 1分钟心率

正确答案：C。靶心率